关于环境改变与机体反应，不正确的是
A. 环境污染物的迁移和转化可影响暴露剂量
B. 污染物的作用剂量与暴露时间有关
C. 生物半减期短的化学污染物可在较短时间内蓄积量达到有害水平
D. 易感人群会在较低的暴露剂量下出现有害效应
E. 影响人群易感性的因素包括遗传因素和非遗传因素

正确答案：C。生物半减期短的化学污染物可在较短时间内蓄积量达到有害水平

解析：本题考查影响体内或靶部位蓄积量的因素的相关内容。除了作用时间以外，影响体内或靶部位蓄积量的重要因素还有化合物的生物半减期和摄入量。生物半减期长的化合物在较短的时间内蓄积量就达到有害作用水平，而生物半减期短的化合物在一定的剂量下长期暴露也不会造成危害（C错，为本题正确答案）。从理论上讲，化学污染物进入机体经历六个生物半减期后，在体内最大可能蓄积量趋于稳定，此后，摄入量与排出量趋于平衡。摄入量愈大，达到平衡后其最大蓄积量也愈大；摄入量少，则体内最大蓄积量也少。